患者，女，18岁。右手食指被铁钉刺伤7天，现头晕头痛，张口不利，咀嚼无力。其诊断是
A. 毒血症
B. 右食指感染
C. 破伤风
D. 败血症
E. 右食指骨折

正确答案：C。破伤风

解析：患者右手食指被铁钉刺伤7天，现头晕头痛，张口不利，咀嚼无力其诊断是破伤风（C对）。毒血症又称脓毒症，指的是细菌毒素从局部的感染病灶进入到血液循环，是一种全身血流感染性疾病，呈急性发作，表现为寒战、高热、气促等，老年、儿童和免疫力低下的人群是易感人群（A错）。右食指感染一般不会出现头晕头痛，张口不利，咀嚼无力等症状（B错）。败血症的概念指的是一些致病菌或者是一些条件致病菌侵入血液循环，并且在血液中生长繁殖，可以产生毒素，而发生的急性的全身感染（D错）。右食指骨折一般会有疼痛，肿胀，功能障碍，骨擦音等（E错）。